男，76岁。慢性阻塞性肺疾病病史30年。3天前受凉后出现寒战、高热、咳嗽、咳胶冻状血痰，伴右侧胸痛。查体：T39.5℃，R28次/分，口唇发绀，双肺呼吸音减弱，右上肺可闻及湿啰音。胸部X线片示右上肺大片状模糊影。该患者最可能的诊断是
A. 真菌性肺炎
B. 肺炎克雷伯杆菌肺炎
C. 干酪性肺炎
D. 葡萄球菌肺炎
E. 肺炎链球菌肺炎

正确答案：B。肺炎克雷伯杆菌肺炎

解析：患者老年男性，慢阻肺病史30年（慢性基础肺病史），3天前受凉后（前期感染史）出现寒战、高热、咳嗽、咳胶冻状血痰（克雷伯杆菌肺炎特征性痰液），伴右侧胸痛（肺部感染常见症状）。查体：T39.5℃，R28次/分，口唇发绀（缺氧体征），双肺呼吸音减弱（提示肺功能差），右上肺可闻及湿啰音（常见肺部感染体征）。胸部X线片示右上肺大片状模糊影（肺部感染常见影像学表现）。结合患者病史、临床表现及相关辅助检查初步诊断为慢支并发克雷伯杆菌肺炎（B对）。真菌性肺炎（A错）痰液中多含有菌丝，主要依赖病理学检验确诊（P54）。结核病是干酪性肺炎的典型代表，其主要特点有：低热、盗汗、咳嗽轻，少量黏痰（C错）（P65）。葡萄球菌（D错）特征性痰液为脓血痰（P44）。链球菌肺炎（E错）特征性痰液为铁锈色痰（P44）。